乙酰CoA是在线粒体内产生的，而FA及Ch是在胞液内以乙酰CoA为原料进行合成的，乙酰CoA通过下列哪种机制由线粒体进入胞液中
A. 乳酸循环
B. 柠檬酸-丙酮酸循环
C. 鸟氨酸循环
D. 三羧酸循环
E. 丙氨酸-葡萄糖循环

正确答案：B。柠檬酸-丙酮酸循环